根据十二经脉流注次序，肾经上交的经脉是
A. 手太阳小肠经
B. 足太阳膀胱经
C. 足厥阴肝经
D. 足少阳胆经
E. 足阳明胃经

正确答案：B。足太阳膀胱经

解析：足太阳膀胱经后项部支脉：通过肩胛骨内缘直下，经过臀部下行，沿大腿后外侧与腰部下来的支脉会合于腘窝中。从此向下，出于外踝后，第五跖骨粗隆，至小趾外侧端（至阴），与足少阴肾经相接（B对）。